导致儿童风湿热的最常见病原体是
A. 肺炎克雷伯杆菌
B. 肺炎链球菌
C. A组乙型溶血性链球菌
D. 流感嗜血杆菌
E. 大肠埃希菌

正确答案：C。A组乙型溶血性链球菌

解析：风湿热种由咽喉部感染A组乙型溶血性链球菌后发生的急性或慢性的风湿性疾病。A组乙型溶血性链球菌（C对）是风湿热最常见的病原体。肺炎克雷伯杆菌（A错）、肺炎链球菌（B错）、流感嗜血杆菌（D错）、大肠埃希菌（E错）均不属于儿童风湿热致病菌的常见病原体。